P和Q两个社区年龄调整死亡率相等，P社区粗死亡率较Q社区低，则可能得出的结论
A. 两个社区有相同的年龄分布
B. 诊断在P社区较Q社区更不正确
C. 诊断在P社区较Q社区更正确
D. P社区较Q社区有更多的年轻人
E. P社区较Q社区有更多的老年人

正确答案：D。P社区较Q社区有更多的年轻人

解析：本题考查率的标准化的应用。两个社区有相等的年龄调整死亡率，说明死亡危险是相同的。之所以粗死亡率不同，是年龄构成不同所造成的。在年龄调整死亡率相同的情况下，粗死亡率越低，说明当地年龄构成越年轻。因此P社区较Q社区有更多的年轻人（D对ABCE错）。